以下在口腔颌面部感染中，最易发生全身并发症的是
A. 颊间隙感染
B. 急性化脓性颌骨骨髓炎
C. 急性化脓性淋巴结炎
D. 智齿冠周炎
E. 面部疖痈

正确答案：E。面部疖痈

解析：在口腔颌面部感染中面部疖痈最易发生全身并发症。这是由于疖痈的病原菌毒力较强，上唇与鼻部“危险三角区”内的静脉又常无瓣膜，颜面表情肌和唇部的生理性运动易使感染扩散等因素所致。掌握“面部疖痈”知识点。